下颌骨的描述,下列哪项正确
A. 下颌支上前、后方的突起分别为冠突和髁状突
B. 髁状突上端膨大为下颌头
C. 下颌头下方称下颌颈
D. 下颌支内面的中部有下颌孔
E. 以上均正确

正确答案：E。以上均正确

解析：下颌骨下颌支末端有两个突起，前方的称冠突，为颐肌附着处，后方的称髁突（A对）。髁突上端的膨大为下颌头（B对），与下颌窝相关节，头下方较细处为下颌颈（C对）。下颌支内面中央有下颌孔（D对）。故以上选项全部正确（E为本题正确答案）。